某女，29岁。咳嗽2月余，干咳无痰，咽喉干痒，时有声音嘶哑。舌红少苔，脉细数。根据脏腑辨证，该证属于
A. 肺气虚
B. 风寒袭肺
C. 肺阴虚
D. 风热犯肺
E. 肝火犯肺

正确答案：C。肺阴虚

解析：本题考查的是肺阴虚证的临床表现及辨证要点。咳嗽2月余，干咳无痰，咽喉干痒，时有声音嘶哑。舌红少苔，脉细数。根据脏腑辨证，该证属于肺阴虚（C对）。肺阴虚证的临床表现及辨证要点：肺阴虚证的临床表现，常见咳嗽较重，干咳无痰，或痰少而黏，并有咽喉干痒，或声音嘶哑，身体消瘦，舌红少津，脉细无力。阴虚火旺还可见咳痰带血，干渴思饮，午后发热，盗汗，两颧发红，舌质红，脉细数。以在肺病常见症状的基础上伴见阴虚内热为辨证要点。肺气虚（A错）证的临床表现及辨证要点：肺气虚证的临床表现，常见咳喘无力，气短懒言，声音低微，或语言断续无力，稍一用力则气吁而喘，周身乏力，自汗出，面色白，舌质淡嫩，脉虚弱等。一般以咳喘无力、气少不足以息和全身功能活动减弱为辨证要点。风寒犯肺（B错）证的临床表现及辨证要点：风寒犯肺证的临床表现，常见咳嗽或气喘，咳痰稀薄，色白而多泡沫，口不渴，常伴有鼻流清涕，或发热恶寒，头痛身酸楚，舌苔薄白，脉浮或弦紧。一般以咳嗽兼见风寒表证为辨证要点。风热犯肺（D错）证的临床表现及辨证要点：风热犯肺证的临床表现，常见咳嗽，咳黄稠痰，不易咳出，甚则咳吐脓血臭痰，一般还伴咽喉疼痛、鼻流浊涕、口干欲饮等，舌尖红，脉浮数。病重者可见气喘鼻扇、烦躁不安。一般以咳嗽与风热表证为辨证要点。肝火犯肺（E错）证的临床表现及辨证要点：肝火犯肺证临床表现，常见胸胁窜痛，咳嗽阵作，甚则咯吐鲜血，性急善怒，烦热口苦，头眩目赤，舌质红，舌苔薄，脉弦数。这些症状，均由肝郁气滞、气郁化火、肝火上逆犯肺所引起。一般以胸胁灼痛、急躁易怒、目赤口苦、咳嗽为辨证要点。